核酸杂交是指
A. 不同的核酸链经变性处理，它们之间形成局部的双链
B. 标记一个已知序列核酸，通过杂交反应确定待测核酸是否含有相同的序列
C. 运输氨基酸
D. 单股DNA恢复成双股DNA
E. 50％双链DNA变性时的温度

正确答案：A。不同的核酸链经变性处理，它们之间形成局部的双链

解析：复性也会发生于不同来源的核酸链之间，形成杂化双链，这个过程称为杂交。掌握“DNA”知识点。